患者，男，25岁。患梅毒疳疮。外治应选用
A. 青黛散
B. 青吹口散
C. 鹅黄散
D. 生肌散
E. 桃花散

正确答案：C。鹅黄散

解析：梅毒，是由梅毒螺旋体所引起的一种全身性、慢性传播性疾病，属于中医的‘霉疮’、‘疳疮’、‘花柳病’等范畴，早期主要表现为皮肤黏膜损害，晚期可造成骨骼及眼部、心血管、中枢神经系统等多种器官组织的病变，一期梅毒，主要表现为疳疮（硬下疳），初为丘疹或浸润性红斑，继之轻度糜烂或呈浅表性溃疡，其上有少量黏液性分泌物或覆盖灰白色薄痂，边缘隆起，边缘及基底部呈软骨样硬度，无痛无痒，直径1～2cm，圆形，呈牛肉色，局部淋巴结肿大。本病例诊断梅毒，一期梅毒明确，疳疮：可选用鹅黄散或珍珠散敷于患处，每日3次，青吹口散，具有清热、解毒和止痛的作用，用于口、舌、咽喉疼痛之疳疮（C对）。青黛散，具有收湿止痒、清热解毒的作用，用于一般皮肤病，焮肿痒痛出水（A错）。生肌散，用于横痃、杨梅结节脓腐除尽之时，用生肌散掺于疮面上，盖红玉膏，每日1次（D错）。桃花散，具有止血的作用，用于疮口出血（E错）。